应提出“建议不宜结婚”的情况是
A. 软骨发育不全
B. 一方或双方患有重度、极重度智力低下神经衰弱
C. 细菌性阴道病
D. 艾滋病病毒携带者
E. 梅毒活动期

正确答案：B。一方或双方患有重度、极重度智力低下神经衰弱

解析：本题考查严重遗传性疾病与婚育的相关内容。严重遗传性疾病婚育指导原则为重度和极重度智力低下（B对ACDE错），不具有婚姻意识能力者，不宜结婚；双方均为遗传性智力低下者，不宜结婚，坚持结婚者不宜生育。